患儿高热，体温达39～40℃，伴恶心、呕吐和意识障碍。应首先考虑的是
A. 中毒型菌痢
B. 癫痫大发作
C. 病毒性脑炎
D. 尿毒症
E. 有机磷农药中毒

正确答案：C。病毒性脑炎

解析：本病例以高热为主症，同时伴有颅内高压：恶心、呕吐及意识障碍等症状，定位于神经系统疾病，病毒性脑炎是由多种病毒感染引起的脑实质的炎症，临床表现以发热、头痛、呕吐、意识障碍或精神异常为主，临床症状与之相符，故首先考虑病毒性脑炎（C对）。中毒型菌痢（A错）是急性细菌性痢疾的危重症，其临床特征为起病急骤，突发高热、反复惊厥、昏迷和休克。癫痫大发作（B错）表现为发作时意识突然丧失，四肢肌肉强直收缩，面色青紫，口吐白沫，可有舌咬伤、大小失禁，阵挛停止后，转入深睡，醒后一如常人。尿毒症（D错）是各种晚期的肾脏病共有的临床综合征，是慢性肾功能衰竭进入终末阶段时出现的一系列临床表现所组成的综合征，可以累积各系统，为慢性疾病，而本病例为急性起病，故不首先考虑。有机磷农药中毒（E错）临床表现为恶心、呕吐、腹痛、多汗、流泪、流涕、流涎、腹泻、尿频、大小便失禁、心跳减慢和瞳孔缩小、支气管痉挛和分泌物增加、咳嗽、气急，严重患者出现肺水肿，有有机磷农药接触史。